与神经管畸形发生发展有关的维生素是
A. 叶酸
B. 核黄素
C. 维生素B₆
D. 硫胺素
E. 烟酸

正确答案：A。叶酸